某男，50岁。感冒数日，症见寒热往来、胸胁苦满、食欲不振、心烦喜呕、口苦咽干，中医诊断为外感病邪犯少阳证。治当解表散热，疏肝和胃。处以小柴胡汤，其药物组成为柴胡、黄芩、党参、大枣、生姜、姜半夏、甘草。处方调配复核，见有类圆形或有不规则薄片，外表皮黄棕色至棕褐色，切面具放射状纹理，味苦的饮片是
A. 党参
B. 柴胡
C. 甘草
D. 黄芩
E. 姜半夏

正确答案：D。黄芩

解析：本题考查的是黄芩的性状鉴别。处方调配复核，见有类圆形或有不规则薄片，外表皮黄棕色至棕褐色，切面具放射状纹理，味苦的饮片是黄芩（D对）。黄芩：【性状鉴别】饮片黄芩片为类圆形或不规则形薄片，外表皮黄棕色至棕褐色，切面黄棕色或黄绿色，具有放射状纹理。党参（A错）：【性状鉴别】饮片呈类圆形的厚片，外表皮灰黄色、黄棕色至灰棕色，有时可见根头部有多数疣状突起的茎痕和芽。切面皮部淡棕黄色至黄棕色，木部淡黄色至黄色，有裂隙或放射状纹理。有特殊香气，味微甜。柴胡（B错）：【性状鉴别】饮片北柴胡呈不规则厚片。外表皮黑褐色或浅棕色，具纵皱纹和支根痕。切面淡黄色，纤维性。质硬。气微香，味微苦。甘草（C错）：【性状鉴别】饮片为类圆形或椭圆形厚片，外表面红棕色或灰棕色，具纵皱纹。切面略显纤维性，黄白色至黄色，形成层环明显，射线放射状，有的有裂隙，显“菊花心”。质坚实，具粉性。气微，味甜而特殊。姜半夏（E错）：【性状鉴别】饮片呈片状、不规则颗粒状或类球形。表面棕色至棕褐色。质硬脆，断面淡黄棕色，常具角质光泽。气微香，味淡，微有麻舌感，嚼之略粘牙。